含有大环内酰胺结构的抗结核药物有
A. 盐酸乙胺丁醇
B. 硫酸链霉素
C. 利福喷丁
D. 利福平
E. 利福布汀

正确答案：C、D、E。利福喷丁；利福平；利福布汀

解析：本题考查抗结核药。含有大环内酰胺结构的抗结核药物有利福喷丁（C对）、利福平（D对）、利福布汀（E对）。利福霉素其化学结构为大环内酰胺，临床上使用的利福霉素类药物是其半合成衍生物，例如利福喷丁、利福平、利福布汀。乙胺丁醇（A错）是开环的结构。硫酸链霉素（B错）是一种氨基葡萄糖型抗生素，分子由链霉胍、链霉糖和N-甲基-L-葡萄糖胺组成，不含有大环内酰胺结构。